口腔软组织的处理有
A. 唇舌系带的矫正术
B. 瘢痕切除修整术
C. 松动软组织切除修整术
D. 口腔黏膜疾患的治疗
E. 以上都对

正确答案：E。以上都对

解析：本题考查修复前口腔软组织的处理。口腔软组织的处理包括：1.唇舌系带的矫正术（A对），唇舌系带接近牙槽嵴顶或舌系带过短，影响义齿的固位和功能活动时应进行系带矫正术；2.瘢痕切除修整术（B对）和松动软组织切除修整术（C对），口腔内瘢痕组织对义齿的稳定和固位有影响时，可考虑切除修整，另有些患者由于戴用不良修复体时间过久，导致骨质大量吸收，牙槽嵴表面为一层松软可移动的软组织所覆盖，这些软组织不但不能有效地支持义齿，有时还会因受压产生炎症及疼痛，可在修复前予以切除修整；3.口腔黏膜疾患的治疗（D对），口腔黏膜也属于口腔软组织，其上的溃疡、炎症等在系统修复治疗前应当给予治疗，如有因配戴义齿导致义齿性口炎的患者，应该给予系统的治疗，并分析致病因素，对因施治，避免复发。综上所述，以上均正确(E对，为本题正确答案)。